牙龈有明显红肿或溃疡，并有自动出血倾向，GI记分为
A. 1
B. 2
C. 3
D. 4
E. 5

正确答案：C。3

解析：牙龈指数（GI）记分标准：
0＝牙龈健康
1＝牙龈轻度炎症：牙龈的色有轻度改变并轻度水肿，探诊不出血
2＝牙龈中等炎症：牙龈色红，水肿光亮，探诊出血
3＝牙龈严重炎症：牙龈明显红肿或有溃疡，并有自动出血倾向掌握“牙周病流行病学及分级预防”知识点。